何某，男，42岁，已婚，女儿上初一，妻下岗待业。近日，他所在的外资企业组织中层职员体检，何某的多数检查结果为正常，但血压值略微升高，为135/90mmHg，心电图显示ST段有轻微改变，甘油三脂略偏高，达1.7mmol/L。虽然何某工作和家庭生活压力较大，但他自我感觉良好，工作精力充沛，饮食睡眠均可，每天拼命工作，没有疲劳与不适感，也未患过什么病，平时连感冒都少见。为此，何某一直未把上述情况当一回事。何某健康状况属于
A. 健康状态
B. 临床疾病状态
C. 亚健康状态
D. 第三状态
E. 亚临床疾病状态

正确答案：E。亚临床疾病状态